精神（心理）性职业紧张属于
A. 生产过程中的有害因素
B. 劳动过程中的有害因素
C. 生产环境中的有害因素
D. 劳动条件中的有害因素
E. 自然环境中的有害因素

正确答案：B。劳动过程中的有害因素

解析：本题考查劳动过程中的有害因素。其主要包括：1.劳动组织和制度不合理、劳动作息制度不合理等；2.精神（心理）性职业紧张（B对ACDE错）；3.劳动强度过大或生产定额不当；4.个别器官或系统过度紧张；5.长时间处于不良体位、姿势或使用不合理的工具等；6.不良的生活方式，如吸烟或过量饮酒、缺乏体育锻炼、个人缺乏健康和预防的知识等。